人际和谐主要体现的内容不包括
A. 乐于与人交往
B. 在交往中保持独立而完整的人格
C. 能客观评价别人
D. 适应外界环境
E. 在交往中积极态度多于消极态度

正确答案：D。适应外界环境